以自言自语，喃喃不休，见人则止为特征的是
A. 谵语
B. 独语
C. 郑声
D. 错语
E. 狂言

正确答案：B。独语

解析：“独语指自言自语，喃喃不休，见人语止，首尾不续的症状，多因心气虚弱，神气不足，或气郁痰阻，蒙蔽心神所致，属阴证，常见于癫病、郁病”（B对）。“谵语指神志不清，语无伦次、声高有力的症状，多属邪热扰心神，属实证，多见于外感热病，温邪内入心包或阳明实热证、痰热扰乱心神等”(A错)。“郑声指神志不清，语言重复，声音低微，时断时续，语声低弱模糊的症状，多因久病脏气衰竭，心神散乱所致，属虚证，见于多种疾病的晚期、危重阶段”（C错）。“错语指病人神志清楚而语言时有错乱，语后自知言错的症状，证有虚实之分，虚证多因心气虚弱，神气不足所致，多见于久病体虚或老年脏气衰微；实证多为痰湿、瘀血、气滞阻碍心窍所致”（D错）。“狂言指精神错乱，语无伦次，狂叫骂詈的症状，多因情志不遂，气郁化火，痰火互结，内扰神明所致，多属阳证、实证，常见于狂病、伤寒蓄血证”（E错）。